检测血液肿瘤标记物癌胚抗原（CEA）对直肠癌病人的意义是
A. 早期诊断
B. 确定是否有转移
C. 分期的依据
D. 决定手术方式
E. 预测预后和监测复发

正确答案：E。预测预后和监测复发

解析：直肠癌复发时，肿瘤细胞增生活跃，分泌大量细胞因子，引起血液肿瘤标记物CEA升高，对直肠癌病人的预测预后和监测复发（E对）有重要的意义。CEA缺乏对直肠癌的早期诊断（A错）价值，并且仅有45%病人升高。确定是否出现肿瘤转移（B错）不靠检测CEA，而是主要依靠影像学手段。肿瘤分期主要由肿瘤浸润深度和淋巴结及远处转移决定，CEA不是分期的依据（C错）。手术方式主要由肿瘤的分期及分级决定，CEA不决定手术方式（D错）。